急性根尖周炎浆液期的临床症状如下，除外
A. 持续自发痛
B. 患牙浮出感
C. 温度测有反应
D. 患牙能明确定位
E. 咬紧牙时痛加重

正确答案：C。温度测有反应

解析：本题考查急性根尖周炎浆液期的临床表现。温度测有反应（C错，为本题正确答案）不是急性根尖周炎浆液期的临床症状。急性根尖周炎浆液期：①初期患牙根尖部不适、木胀浮出感（B对），咬合时与对（牙合）牙有早接触感，有时用力咬紧患牙反而稍感舒服。尚无自发痛或仅轻微钝痛。②随着病情发展，患牙浮出和伸长的感觉逐渐加重，出现自发性、持续性钝痛（A对），咬合时不仅不能缓解症状，反而引起较剧烈的疼痛（E对），影响进食。③疼痛范围局限于患牙根部，不引起放散，患者能够指明患牙（D对）。